胃与十二指肠在表面分界的标志是
A. 角切迹
B. 中间沟
C. 幽门前静脉
D. 胃左静脉
E. 胃右静脉

正确答案：C。幽门前静脉

解析：胃的出口为幽门，是胃与十二指肠的分界，其上为幽门前静脉，是确定幽门的标志，故幽门前静脉(C对)为胃与十二指肠在表面分界的标志。